急性心肌梗死发生后，最早升高的血清心肌酶是
A. 肌酸磷酸激酶
B. 天门冬酸氨基转移酶
C. 乳酸脱氢酶
D. 肌酸磷酸激酶同工酶
E. 肌钙蛋白I

正确答案：D。肌酸磷酸激酶同工酶

解析：肌钙蛋白I起病3～4小时后升高，但其不属于心肌酶（E错）。肌酸磷酸激酶（A错）于心肌梗死4小时内升高。天门冬酸氨基转移酶（B错）于发病后6～10小时开始升高。乳酸脱氢酶（C错）于发病后6～10小时开始升高。肌酸磷酸激酶同工酶（D对）起病4小时内升高。